用于弱酸性药物液体制剂的常用抗氧化剂是
A. 酒石酸
B. 硫代硫酸钠
C. 焦亚硫酸钠
D. 依地酸二钠
E. 维生素E

正确答案：C。焦亚硫酸钠

解析：本题考查抗氧化剂。焦亚硫酸钠（C对）是用于弱酸性药物液体制剂的常用抗氧剂。常用的水溶性抗氧剂有：亚硫酸钠、亚硫酸氢钠、焦亚硫酸钠、硫代硫酸钠、硫脲、维生素C、半胱氨酸等。常用的油溶性抗氧剂有叔丁基对羟基茴香醚（BHA）、2，6-二叔丁基甲酚（BHT）、维生素E（E错）等。焦亚硫酸钠和亚硫酸氢钠适用于弱酸性溶液；亚硫酸钠常用于偏碱性药物溶液；硫代硫酸钠（B错）在酸性药物溶液中可析出硫细颗粒沉淀，故只能用于碱性药物溶液。常用的金属离子络合剂有依地酸二钠（D错）、枸橼酸、酒石酸（A错）等。